举止端庄，语言文明，态度和蔼，同情关心和体贴病人是《医务人员医德规范及实施办法》内容要求的
A. 技术考核结果
B. 文明礼貌服务
C. 上岗前医德培训
D. 医务人员行为规范
E. 医德考核结果

正确答案：E。医德考核结果

解析：医德考核基本内容包括：救死扶伤，全心全意为人民服务；尊重患者权力，为患者保守医疗秘密；文明礼貌，优质服务，构建和谐医疗关系；遵纪守法，廉洁行医；因病施治，规范医疗服务行为；顾全大局，团结协作，和谐共事；严谨求实，努力提高专业技术水平（E对）。